心肌慢反应细胞动作电位0期去极化的形成是由于
A. Na⁺内流
B. K⁺外流
C. Cl⁻内流
D. Ca²⁺内流
E. Ca²⁺外流

正确答案：D。Ca²⁺内流